因抢救急危患者，未及时书写病历的，有关医务人员应在抢救结束后据实补记，并加以注明，其期限是
A. 2小时内
B. 4小时内
C. 6小时内
D. 8小时内
E. 12小时内

正确答案：C。6小时内

解析：因抢救急危患者，未及时书写病历的，有关医务人员应在抢救结束后据实补记，并加以注明，其期限是6小时（C对）。